某患者自觉左侧肢体似有蚂蚁爬行，此种感觉障碍为
A. 感觉过敏
B. 感觉倒错
C. 感觉过度
D. 感觉异常
E. 感觉减退

正确答案：D。感觉异常

解析：某患者自觉左侧肢体似有蚂蚁爬行，此种感觉障碍为感觉异常（D对）。感觉异常是指在无外界刺激的情况下，自觉身体某部位有不舒适或者难以忍受的异样感觉。 　　这种异样感觉如果发生在躯体内部且不能确切的指明不适的具体部位，则称为内感性不适。感觉异常常见于疑病观念、抑郁状态、精神分裂症以及颅脑外伤后精神障碍等，也可偶见于血栓闭塞性脉管炎等。感觉过敏（A错）又称感觉增强，由感觉阈值降低或强烈的情绪因素所致。临床表现为患者对一般强度的刺激反应特别强烈、难于忍受，比如不能忍受电话铃声、关门声、冷水、阳光等。感觉倒错（B错）指对外界刺激产生与正常人不同性质或相反性质的异常感觉。感觉过度（C错）是由于病变的影响，刺激必须达到较强的程度才能被感知。病人通常只能感知强烈的疼痛刺激及温热刺激。感觉减退（E错）是指对外界刺激感受性减低的感知障碍。如强烈的疼痛刺激，只引起轻微感觉甚至无感觉。